下列哪种维生素是脂溶性维生素
A. 硫胺素
B. 尼克酸
C. 视黄醇
D. 抗坏血酸
E. 维生素PP

正确答案：C。视黄醇